表示药物有渗湿利水作用的味是
A. 涩味
B. 辛味
C. 酸味
D. 淡味
E. 咸味

正确答案：D。淡味

解析：本题考查的是五味对人体的效果。表示药物有渗湿利水作用的味是淡味（D对）。五味对人体的效果：（1）辛（B错）：能散、能行，有发散、行气、活血作用。（2）甘：能补、能缓、能和，有补虚、和中、缓急、调和药性等作用。（3）酸（C错）：能收、能涩，有收敛固涩作用。（4）苦：能泄、能燥、能坚。（5）咸（E错）：能软、能下，有软坚散结、泻下通便作用。（6）涩（A错）：能收、能敛，同酸味一样有收敛固涩作用。（7）淡：能渗、能利，有渗湿利水作用。常将淡附于甘。此外，还有芳香味，其能散、能行、能开，有化湿、辟秽、开窍、醒脾等作用。习惯将芳香归为五臭之列，有的也标上辛味，称为辛香之气。